当上下颌牙咬合过紧，且牙本质过敏不能磨出（牙合）支托窝时，上颌后牙的（牙合）支托可以放在
A. 近中边缘嵴
B. 远中边缘嵴
C. 颊外展隙
D. 颊沟区
E. 舌沟区

正确答案：D。颊沟区

解析：（牙合）支托的位置：（牙合）支托应在基牙的近远中边缘嵴上。如果因咬合过紧而不易获得支托位置时，可放在上颌磨牙的颊沟处，或放在下颌磨牙的舌沟处。尖牙的舌隆突上也可放（牙合）支托，如尖牙无明显舌隆突或有龋坏，可先用3/4冠或全冠修复尖牙外形，并留出（牙合）支托凹，然后在凹内放置（牙合）支托。也可放在基牙的切缘上（切支托）。掌握“局部义齿固位体”知识点。